男，66岁。活动后突发左侧胸痛伴呼吸困难1天。既往慢性阻塞性疾病史10余年。查体：R26次/分，BP95/60mmHg。口唇发绀，左肺呼吸音明显减弱，心率102次/分，律齐。该患者最可能的诊断是
A. 急性心肌梗死
B. 自发性气胸
C. 阻塞性肺不张
D. 胸腔积液
E. 肺栓塞

正确答案：B。自发性气胸

解析：患者为老年男性，既往慢性阻塞性疾病史，活动后突发左侧胸痛伴呼吸困难，口唇发绀，左肺呼吸音明显减弱，提示自发性气胸（B对）（自发性气胸是指因肺部疾病使肺组织和脏层胸膜破裂，或靠近肺表面的肺大疱、细微气肿疱自行破裂，使肺和支气管内空气逸入胸膜腔）。急性心肌梗死（P236）（A错）的主要表现为心前区疼痛，程度剧烈，常伴有心律失常，心电图呈特征性和动态性改变，呼吸音无明显减弱。阻塞性肺不张（C错）是指支气管腔有阻塞性病变，引起肺叶不张，伴有呼吸困难，但没有突然发生的胸痛。胸腔积液（P115）（D错）常由炎症、结核或肿瘤病变引起，有原发病的表现，胸腔积液的主要表现为呼吸困难，多伴有咳嗽和胸痛，呼吸音减弱或消失，常可闻及胸膜摩擦音。肺栓塞（P100）（E错）主要表现为不明原因的活动后呼吸困难及气促，胸痛及咯血，听诊可闻及肺动脉瓣区第二心音亢进，三尖瓣区收缩期杂音。